以下有关三叉神经的描述中，不恰当的是
A. 三叉神经是脑神经中最大者
B. 三叉神经是口腔颌面部主要的感觉神经
C. 三叉神经是表情肌的运动神经
D. 三叉神经是口腔颌面部本体感觉神经
E. 三叉神经是混合神经

正确答案：C。三叉神经是表情肌的运动神经

解析：三叉神经是脑神经中最大者，属混合性神经，是口腔颌面部主要的感觉神经和咀嚼肌的运动及本体感觉神经。有三条分支，分别称为眼神经、上颌神经和下颌神经。掌握“三叉神经的分支与分布”知识点。